治疗急性梗阻性化脓性胆管炎最关键措施是
A. 胆总管切开减压
B. 胆囊切开减压
C. 抗休克治疗
D. 应用广谱抗生素
E. 纠正水电解质紊乱

正确答案：A。胆总管切开减压

解析：急性梗阻性化脓性胆管炎的发病基础是胆道梗阻及细菌感染。如果在疾病发展过程中，胆道梗阻不能解除，胆管内细菌引起的感染得不到控制，将会危及患者生命。胆总管切开减压（A对）是治疗急性梗阻性化脓性胆管炎的最关键措施。胆囊切开减压（B错）对解除胆管梗阻作用不大。抗休克治疗（C错）对于病人治疗有重要意义，但不属于最关键治疗。应用广谱抗生素（D错）、纠正水电解质紊乱（E错）属于一般性治疗措施。